全心衰竭的主要表现是
A. 肺淤血
B. 肝肿大压痛
C. 两者均有
D. 两者均无
E. 无

正确答案：C。两者均有

解析：全心衰竭时，左、右心室输出量不足，使心脏收缩后残留于两心室内的血液增多，心室舒张期充盈压升高，肺循环、体循环血液回流均受阻，前者可表现为肺淤血、水肿，后者可表现为体循环静脉充盈、内脏淤血如肝肿大压痛（AB对，故C为本题正确答案）、水肿。